5岁男孩，发热1天，腹泻6～7次，为粘液性脓血便，腹痛伴里急后重，病前吃过未洗的黄瓜，大便常规检查：粘液便，红白细胞满视野，诊断为细菌性痢疾。其类型属于
A. 普通型
B. 轻型
C. 重型
D. 中毒型
E. 慢性型

正确答案：A。普通型

解析：5岁男性患儿，病前吃过未洗的黄瓜，一天前发生腹泻，黏液脓血便，腹痛伴里急后重，根据患者的临床表现，应诊断为普通型细菌性痢疾（A对）。轻型（B错）全身毒血症状轻微，稀便有粘液无脓血。重型（C错）多见于老年、体弱、营养不良患者，腹泻每天30次以上。中毒型（D错）起病急，全身中毒症状严重，可有嗜睡，昏迷及抽搐，迅速发生循环和呼吸衰竭。临床以严重毒血症状、休克和（或）中毒性脑病为主。慢性型（E错），菌痢反复发作或迁延不愈达2个月以上者。